可用硫色素反应鉴别的药物是
A. 地西泮
B. 黄体酮
C. 维生素B₁
D. 维生素C
E. 盐酸麻黄碱

正确答案：C。维生素B₁

解析：本题考查维生素B₁的鉴别反应。硫色素反应为维生素B₁（C对）的专属性鉴别反应。维生素B₁在碱性溶液中可被铁氰化钾氧化生成硫色素，硫色素溶于正丁醇（或异丁醇等）中显蓝色荧光。